关于显微血管缝合术的基本要求叙述中，正确的是
A. 吻合口的血管内膜应紧密接触
B. 没有外膜植入吻合口
C. 吻合口不产生狭窄
D. 吻合后的血管应无张力
E. 以上都是

正确答案：E。以上都是

解析：显微血管缝合术的基本要求是：①吻合口的血管内膜应紧密接触；②没有外膜植入吻合口；③吻合口不产生狭窄；④吻合后的血管应无张力。掌握“口腔颌面部后天畸形概论”知识点。